人体胚胎干细胞研究和应用的伦理原则是
A. 研究后的胚胎可以植入子宫继续发育
B. 不能使用丢弃的胚胎
C. 研究前必须向干细胞审议小组提出申请，获准后方可进行
D. 禁止买卖人体胚胎，可请妇女制造胚胎
E. 爱惜和尊重胚胎，只允许用28天内的胚胎

正确答案：C。研究前必须向干细胞审议小组提出申请，获准后方可进行

解析：干细胞临床研究机构伦理委员会负责对干细胞临床研究项目进行独立伦理审查，研究前必须向其提出申请，获准后方可进行（C对）。用于研究的人胚胎干细胞只能通过下列方式获得：体外受精时多余的配子或囊胚；自然或自愿选择流产的胎儿细胞；体细胞核移植技术所获得的囊胚和单性分裂囊胚；自愿捐献的生殖细胞（BD错）。利用体外受精、体细胞核移植、单性复制技术或遗传修饰获得的囊胚，其体外培养期限自受精或核移植开始不得超过 14 天，且不得将其植入人或任何其他动物的生殖系统（AE错）。